某电石车间维修工，当日上午从事更换精馏塔管道作业，见到有大量液体自管道流出，闻到芳香气味，即觉舌根发麻，头晕、站立不稳，随后昏倒在地，不省人事，送到医院就诊后，患者意识清楚，面部潮红，口唇轻度发绀，其原因是可能是
A. 氟化氢中毒
B. 氰化氢中毒
C. 苯中毒
D. 氯化氢中毒
E. 硫化氢中毒

正确答案：C。苯中毒